网膜孔
A. 小网膜与腹腔的交通途径
B. 后界是下腔静脉表面的腹膜
C. 前界是肝胃韧带
D. 上界是肝方叶
E. 下界是十二指肠水平部

正确答案：B。后界是下腔静脉表面的腹膜

解析：网膜孔为小网膜与网膜囊的交通途径(A错)，其后界为下腔静脉表面的腹膜(B对)，前界为肝十二指肠韧带(C错)，上界为肝尾状叶(D错)，下界为十二指肠的上部(E错)。